治缺乳常用药中，能通经下乳的有
A. 木通
B. 路路通
C. 穿山甲
D. 通草
E. 王不留行

正确答案：A、B、C、E。木通；路路通；穿山甲；王不留行

解析：本题考查的是木通、路路通、穿山甲与王不留行的功效。治缺乳常用药中，能通经下乳的有木通（A对）、路路通（B对）、穿山甲（C对）与王不留行（E对）。木通：【功效】利水通淋，泄热，通经下乳。路路通：【功效】祛风活络，利水，通经下乳，止痒。穿山甲：【功效】活血消癥，通经下乳，消肿排脓。王不留行：【功效】活血通经，下乳消肿，利尿通淋。通草（D错）：【功效】利水清热，通气下乳。